某中学生，15岁。经骨髓穿刺检查诊断为“急性淋巴细胞白血病”，给以常规治疗，症状无缓解。医生告诉家长，此病目前尚无理想的治疗方法，医院正在尝试使用一种疗效不肯定、有一定风险的药物，其家长表示愿意做这种试验性治疗，但没有履行书面承诺手续，治疗二天后，病人病重，抢救无效，死亡。此后，家属否认曾同意这种治疗方案，称是“拿病人做试验”，要追究医生责任，于是造成医疗纠纷。病人家属称本案是“拿病人做试验”并告上法庭，理由如下，但其真实的思想最可能的是
A. 家长没有书面承诺，说明对该方案有保留意见
B. 抢救不够及时，拖延了时间
C. 家长没签字，医生必须承担患儿死亡的责任
D. 要求减免住院费用
E. 医生所做的试验缺乏临床数据积累

正确答案：D。要求减免住院费用

解析：由于失去亲人，家属最可能的要求可能为经济补偿。掌握“医患关系伦理”知识点。